环状软骨平面位于
A. 第4颈椎体
B. 第5颈椎体
C. 第6颈椎体
D. 第6胸椎体
E. 第7胸锥体

正确答案：C。第6颈椎体

解析：环状软骨平面位于第6颈椎体（C对）。